牙胶尖的主要成分
A. 牙胶
B. 氧化锌
C. 蜡
D. 松香
E. 重金属磷酸盐

正确答案：B。氧化锌

解析：本题考查根管充填材料的种类和特点。牙胶尖的主要成分是氧化锌（B对）。目前临床上常用的根管充填材料是牙胶尖和根管封闭剂。其中，牙胶尖由19%～22%牙胶、59%～75%氧化锌及少量蜡、颜料、抗氧化剂和重金属磷酸盐组成。